房水是由下述哪个结构产生的
A. 晶状体
B. 玻璃体
C. 睫状体
D. 巩膜静脉窦
E. 脉络膜

正确答案：C。睫状体

解析：房水是由睫状体（C对）产生的。